明确疾病的诊断和药物的性能，选择治本或标本兼治的药物符合
A. 合理配伍细致观察
B. 节约费用公正分配
C. 对症下药剂量安全
D. 关心体贴细致入微
E. 知情同意保守医密

正确答案：C。对症下药剂量安全

解析：对症下药是指医务人员根据临床诊断选择相适应的药物进行治疗。为此必须首先明确疾病的诊断和药物的适应证和禁忌证，然后选择治本或者是标本兼治的药物，如果疾病诊断未明而且病情较为严重或者诊断明确，而无可供选择的标本兼治的药物可以暂时应用治标的药物，以减轻病痛和并发症。在对症下药的前提下还要求医务人员因人而异，掌握好药物的剂量，因为用药剂量与患者的年龄、体重、体质、重要脏器的功能、用药史以及对药物反应的差异性等多种因素有关（C对）。